食物中毒的流行病学特点是
A. 中毒的发生与吃某种食物有关
B. 以集体暴发多见
C. 发病具有明显的季节性、地区性
D. 以细菌性食物中毒为主
E. 以上都是

正确答案：E。以上都是